根据《执业药师资格制度暂行规定》，张某考试合格取得《执业药师资格证书》后，张某可以
A. 直接在所在省、市的药品零售企业以执业药师身份执业
B. 直接在所在省、市的药品批发企业以执业药师身份执业
C. 直接在跨省、市的药品零售连锁企业以执业药师身份执业
D. 经注册后，在注册所在省、市以执业药师身份执业
E. 经注册后，同时在多个单位以执业药师身份执业

正确答案：D。经注册后，在注册所在省、市以执业药师身份执业

解析：本题考查的是执业药师的注册。根据《执业药师资格制度暂行规定》，张某考试合格取得《执业药师资格证书》后，张某可以经注册后，在注册所在省、市以执业药师身份执业（D对）。《执业药师资格制度暂行规定》第十二条规定，取得《执业药师资格证书》者，须按规定向所在省（区、市）药品监督管理局申请注册。经注册后，方可按照注册的执业类别、执业范围从事相应的执业活动（E错）。未经注册者，不得以执业药师身份执业（ABC错）。